在牙齿发育过程中比其他牙源性间充质干细胞更具有增殖能力和矿化能力的复合体细胞是
A. 牙髓-牙本质复合体
B. 牙根-牙周膜复合体
C. 牙槽骨-牙周膜复合体
D. 发育期根端复合体
E. 年轻恒牙根尖乳头

正确答案：D。发育期根端复合体

解析：在牙齿发育早期作为一个整体性的功能复合物被称为发育期根端复合体。发育期根端复合体较其他牙源性间充质干细胞具有更强的增殖能力和矿化能力。掌握“牙体、牙周组织的形成”知识点。